引起高钾血症最重要的原因是
A. 酸中毒
B. 使用β受体阻滞剂
C. 洋地黄中毒
D. 肾排钾障碍
E. 摄钾过多

正确答案：D。肾排钾障碍

解析：肾排钾障碍（D对）致高钾血症常见于肾衰竭、盐皮质激素缺乏长期应用潴钾利尿剂等情况，是高钾血症最重要的病因。酸中毒（A错）、使用β受体阻滞剂（B错）、洋地黄中毒（C错）、摄钾过多（E错）均会导致高钾血症，但不是引起高钾血症最重要的原因。